患者下胸部前面的肋骨外翻，沿膈附着的部位其胸壁向内凹陷，肋骨与肋软骨交界处隆起，形成串珠状。其诊断是
A. 肺肿瘤
B. 肺结核
C. 肺气肿
D. 佝偻病
E. 脊柱结核

正确答案：D。佝偻病

解析：本例患者下胸部前面的肋骨外翻，沿膈附着的部位其胸壁向内凹陷，肋骨与肋软骨交界处隆起，形成串珠状，符合佝偻病（D对）的诊断。部分肺肿瘤（A错）、肺结核（B错）患者可出现扁平胸，胸廓特点为胸廓呈扁平状，其前后径不及左右径的一半。肺气肿（C错）患者可出现桶状胸，胸廓特点为胸廓前后径增加，有时与左右径几乎相等，甚或超过左右径，呈圆桶状。脊柱结核（E错）患者由于椎体被破坏、压缩可出现脊柱后凸。